女，53岁。月经紊乱2年，停经6个月，近3个月来有潮热，汗多，入睡困难，B超发现左侧卵巢囊肿，直径4cm，子宫内膜活检病理结果显示：子宫内膜息肉。引起患者不适的原因是
A. 左卵巢囊肿
B. 绝经综合征
C. 神经官能症
D. 子宫内膜息肉
E. 月经不调

正确答案：B。绝经综合征

解析：中年女性，月经紊乱2年，停经6个月，近3个月来有潮热，汗多，入睡困难（绝经综合征的典型临床表现），B超发现左侧卵巢囊肿，子宫内膜活检病理结果显示：子宫内膜息肉，引起患者不适的原因是绝经综合征（B对），因雌激素下降，进而导致血管舒缩，从而导致潮热，汗多，入睡困难。卵巢囊肿（A错）多没有临床表现，体积较大者可能会出现下腹部不适、坠胀。神经官能症（C错）主要表现为焦虑、抑郁、恐惧、强迫和神经衰弱。该患者是在子宫内膜活检时发现子宫内膜息肉，一般这种刮诊发现的息肉较小，不会引起患者不适（D错）。月经不调（E错）主要表现为月经周期的延长或缩短，经量增多或减少，可能会伴有腹痛、贫血、头晕乳房疼痛等。